患者呼吸浅短难续，声低气怯，张口抬肩，咳嗽，痰白如沫，胸闷心悸，形寒汗出，舌质暗，脉沉细数无力。其治法是
A. 补肺健脾，化痰活血
B. 温肾健脾，化痰利水
C. 温肺化饮，化痰平喘
D. 补肺纳气，降气平喘
E. 温肺健脾，化痰利水

正确答案：D。补肺纳气，降气平喘

解析：患者呼吸浅短难续，声低气怯，张口抬肩，咳嗽，痰白如沫，胸闷心悸，形寒汗出，诊断为肺胀。肺肾两虚，不能主气、纳气，故呼吸浅短难续，声低气怯，张口抬肩；寒饮伏肺，肾虚水泛则咳痰色白如沫；肺病及心，心气虚弱，故心悸，形寒汗出。结合舌脉分析，本病属于肺肾两虚之肺胀，故宜采用补肺纳气，降气平喘的治法（D对）。补肺健脾，化痰活血的治法用于肺脾两虚，不用于肺肾气虚的肺胀（A错）。温肾健脾，化痰利水的治法用于脾肾两虚证，又有痰饮内停（B错）。温肺化饮，化痰平喘的治法用于肺虚寒证，又有痰饮内停之咳喘，不用于肺肾气虚的肺胀（C错）。温肺健脾，化痰利水的治法用于肺脾两虚证，又有痰饮内停，临床表现面色少华、手足不温、怠倦食少、便溏、咳嗽、短气、痰多，舌淡嫩苔白，脉虚或虚数等证候（E错）。